某男性患者，30岁，有吸毒史（注射）。近半年来体重减轻，发烧，口腔反复发生真菌感染。首先考虑为AIDS。在艾滋病的治疗中，经常选用的抗病毒药是
A. 无环鸟苷
B. 金刚烷胺
C. 金刚乙胺
D. 齐多夫定
E. 利巴韦林

正确答案：D。齐多夫定

解析：本题考查艾滋病的治疗。某男性患者，30岁，有吸毒史（注射）。近半年来体重减轻，发烧，口腔反复发生真菌感染。首先考虑为AIDS。在艾滋病的治疗中，经常选用的抗病毒药是齐多夫定（D对），属于核苷类药物。无环鸟苷（A错）又名阿昔洛韦（ACV）为单纯疱疹病毒感染的首选药，局部应用治疗疱疹性角膜炎、单纯疱疹和带状疱疹，口服或静注可有效治疗单纯疱疹脑炎、生殖器疱疹、免疫缺陷患者单纯疱疹感染等。金刚烷胺（B错）、金刚乙胺（C错）均可特异性抑制A型流感病毒，大剂量也可抑制B型流感病毒、风疹和其他病毒；金刚乙胺是金刚烷胺的a-甲基衍生物，金刚乙胺抗A型流感病毒的作用优于金刚烷胺，抗病毒谱也较广，主要用于预防A型流感病毒的感染；金刚烷胺尚具有抗震颤麻痹作用。利巴韦林（E错）是一种人工合成的鸟苷类衍生物，为广谱抗病毒药，对急性甲型和丙型肝炎有一定疗效，治疗呼吸道合胞病毒肺炎和支气管炎效果最佳，通常以小颗粒气雾剂给药，流感也用气雾剂给药，而其他大多数病毒感染则通过静脉注射进行治疗。